青年男性，2天来胸背部疼痛，今出现双下肢无力，伴二便障碍，查脐以下各种感觉障碍，双下肢肌力0级，无病理反射。首先应做的有诊断意义的检查是
A. 腰穿脑脊液检查
B. 头部MRI
C. 颈椎MRI
D. 胸椎MRI
E. 腰椎MRI

正确答案：D。胸椎MRI

解析：患者初步诊断为急性脊髓炎。急性脊髓炎又称急性横贯性脊髓炎，患者已经出现显的脐以下横贯性损害症状，根据脊髓分布特点，病损应在T9-T10，应首选胸椎MRI（D对BCE错）明确病损部位及程度，并帮助判断病因。腰穿脑脊液检查（A错）会有阳性表现，有助于疾病的病因诊断，但无法明确病损部位及程度。故该患者首先应做的有诊断意义的检查是胸椎MRI（D对）。